男，20岁。腰痛3年，膝关节痛2个月。查体：右膝肿胀、压痛，浮髌试验阴性。实验室检查：血尿酸正常，HLA-B27阳性。X线：双侧骶髂关节骨侵蚀改变，伴间隙狭窄。最可能的诊断是
A. 痛风关节炎
B. 反应性关节炎
C. 强直性脊柱炎
D. 银屑病关节炎
E. 感染性关节炎

正确答案：C。强直性脊柱炎

解析：患者青年男性（强直性脊柱炎的好发人群），腰痛3年，膝关节痛2个月（强直性脊柱炎常伴下腰背痛，晚期可出现膝关节疼痛）。查体：右膝关节肿胀、压痛，浮髌试验阴性。实验室检查：HLA-B27阳性（90%左右的强直性脊柱炎患者HLA-B27阳性）。X线：双侧骶髂关节骨侵蚀改变，伴间隙狭窄（强直性脊柱炎的常见X线表现）。综合患者的临床表现、查体、实验室检查和影像学检查，最有可能的诊断是强直性脊柱炎（C对）。痛风关节炎（P861）（A错）主要表现为夜间或清晨突然起病，关节剧痛，呈撕裂样、刀割样或咬噬样，多于数天或2周自行缓解，血尿酸值常偏高。反应性关节炎（P825）（B错）与强直性脊柱炎都属于脊柱关节炎，但病变部位多为病变关节，一般不会出现典型的下腰痛和骶髂关节破坏表现。银屑病关节炎（P811）（D错）多于银屑病若干年后发生，常有远端指间关节处的对称性多关节炎。感染性关节炎（E错）指细菌、病毒等微生物入侵关节腔内导致的关节炎症，主要表现为四肢大关节游走性疼痛，可有局部红肿，一般经1～2周自愈。